女，24岁，到国外读书。刚到国外半年时因语言不通，生活习惯不同等原因，感觉不适应，该反应的应激源为
A. 社会性应激源
B. 躯体性应激源
C. 心理性应激源
D. 文化性应激源
E. 职业性应激源

正确答案：D。文化性应激源

解析：女，24岁，到国外读书。刚到国外半年时因语言不通，生活习惯不同等原因，感觉不适应（属于文化性性因素导致的应激反应），故该反应的应激源为文化性应激源（D对）。社会性应激源（A错）是指由于社会因素引起的应激本源。躯体性应激源（B错）指作用于人的机体，直接产生刺激作用的刺激物，包括各种理化和生物刺激生物和疾病等。心理性应激源（C错）直接来源于人的头脑，但也常常是外部刺激作用的结果。职业性应激源（E错）并不是应激源的分类。